不属于与性行为相关的社会病分类的是
A. 已婚妇女妊娠
B. 青少年妊娠
C. 对人性的摧残
D. 卖淫嫖娼
E. 传播色情物品

正确答案：A。已婚妇女妊娠

解析：本题考查与性行为相关的社会病的分类。与性行为相关的社会病可以大致分为以下3类：①各类与性行为相关的违法犯罪行为，如强奸、卖淫嫖娼（D对）、制造和传播色情物品（E对）等；②不安全性行为导致的各类问题，如性传播疾病、艾滋病、意外妊娠特别是青少年妊娠（B对）等；③与性禁锢相关的各类问题，如对人性的摧残（C对）、性无知导致的种种问题等。已婚妇女妊娠（A错，为本题正确答案）不属于与性行为相关的社会病。